以下哪种细胞是不需要致敏过程即可杀伤肿瘤细胞的固有免疫淋巴细胞
A. T淋巴细胞
B. B淋巴细胞
C. 中性粒细胞
D. NK细胞
E. 抗原提呈细胞

正确答案：D。NK细胞

解析：自然杀伤细胞（NK细胞）是一类可不需要致敏即可杀伤病毒感染细胞和肿瘤细胞的固有免疫淋巴细胞。掌握“NK细胞、抗原提呈及其他免疫细胞”知识点。